突触前抑制是由于突触前膜
A. 产生超极化
B. 释放抑制性递质
C. 递质耗竭
D. 兴奋性递质释放减少
E. 产生抑制性突触后电位

正确答案：D。兴奋性递质释放减少

解析：突触前抑制的结构基础是轴突-轴突式突触和轴突-胞体式突触联合构成，突触前膜被兴奋性递质去极化后（A错），使动作电位幅度变小，时程缩短，结果使进入突触前膜的Ca²⁺减少，由此引起递质释放量减少（D对），导致兴奋性突触后电位（EPSP）减小，使突触后膜兴奋性减低，产生抑制作用。突触前抑制是因为兴奋性递质释放量减少，而不是递质耗竭（C错）和释放抑制性递质（B错）。突触前抑制导致的是突触后神经元产生较以前小的兴奋性突触后电位（EPSP），而不是抑制性突触后电位（IPSP）（E错）。